患者男，62岁，患肾癌1年。近1周来，腰痛，坠胀不适，尿血，低热，身体沉困，饮食不佳，舌体胖，苔白腻，脉滑数。其中医治法是
A. 健脾益肾，软坚散结
B. 养阴清热凉血
C. 清热利湿，解毒化瘀
D. 活血化瘀，理气散结
E. 补益气血

正确答案：C。清热利湿，解毒化瘀

解析：患者，男，62岁患肾癌1年（高发年龄50～70岁，男女患者发病率比例约为2:1），加重1周。湿热累及于肾故见腰痛，坠胀不适；湿热灼伤血络故见尿血；湿热外蒸故见低热；湿性重浊故见身体沉困，湿邪困脾故见饮食不佳，湿热蕴结故见舌体胖，苔白腻，脉滑数（C对）。脾肾两虚证，治法：健脾益肾，软坚散结，方药：四物汤合右归饮加减（A错）。肾阴亏虚证，治法：养阴清热凉血，方药：知柏地黄汤加减（B错）。瘀血内阻证，治法：活血化瘀，理气散结。方药：桃红四物汤加减（D错）。气血两虚证，治法：补益气血。方药：八珍汤加减（E错）。